与水肿关系最为密切的脏腑是
A. 肺、脾、肾
B. 肺、胃、肾
C. 心、脾、肾
D. 肝、脾、肾
E. 心、肝、肾

正确答案：A。肺、脾、肾

解析：水肿的病机为肺失通调、脾失转输、肾失开阖、三焦气化不利。清·喻昌《医门法律》所持三纲病机学说（水病以肺、脾、肾为三纲），论亦类似，都认为本病为肺、脾、肾相干之病。因为水为至阴，故其本在肾；水化于气，其标在肺；水惟畏土，其制在脾（A对）。这些都是命门学说在水肿病机上的具体应用。至此水肿病的肺、脾、肾三纲病机学说已经成立。